以下关于病毒感染的标本采集与送检的叙述中，不正确的说法是
A. 发病初期或急性期采集的标本，易于分离出病毒
B. 不同的病毒感染，采集不同类型的标本
C. 标本采集后应立即送往病毒实验室
D. 病毒在室温中不容易灭活，不需要冷藏
E. 血清学诊断的标本，应在患者急性期和恢复期各取一份血液

正确答案：D。病毒在室温中不容易灭活，不需要冷藏

解析：发病初期或急性期采集的标本，易于分离出病毒。应根据不同的病毒感染，采集不同类型的标本。病毒在室温中很容易灭活，故标本采集后应立即送往病毒实验室，否则应将标本低温冷藏。血清学诊断的标本，应在患者急性期和恢复期各取一份血液，以便对比双份血清中抗体效价，通常恢复期血清的抗体效价比急性期增高4倍以上才有诊断意义。掌握“病毒感染检查方法及防治原则”知识点。